根据《中药品种保护条例》，不可以申请中药品种保护的是
A. 天然药物提取物
B. 天然药物提取制剂
C. 中药人工制品
D. 已申请专利的中药制剂

正确答案：D。已申请专利的中药制剂

解析：本题考查《中药品种保护条例》的适用范围。根据《中药品种保护条例》，不可以申请中药品种保护的是已申请专利的中药制剂（D错，为本题正确答案）。《中药品种保护条例》的适用范围：适用于中国境内生产制造的中药品种，包括中成药、天然药物的提取物（A对）及其制剂（B对）和中药人工制品（C对）。申请专利的中药品种，依照专利法的规定办理，不适用《中药品种保护条例》。申请专利的中药品种除外。国家药品监督管理部门负责全国中药品种保护的监督管理工作。